造成疾病季节性流行的因素不包括
A. 营养素摄入不同
B. 病原体繁殖高峰
C. 病原体的变异速度
D. 宿主动物繁殖高峰
E. 虫媒繁殖高峰

正确答案：C。病原体的变异速度

解析：本题考查造成疾病季节性流行的因素。造成疾病季节性流行的因素包括：自然环境、气候条件、媒介昆虫、野生动物的生活习性和家畜的生长繁殖（BDE对）等因素；人的生活方式、生产、劳动条件、营养（A对）、风俗习惯、医疗卫生水平、暴露于致病因素的机会和人群易感性等因素。病原体的变异速度（C错，为本题正确答案）不是造成疾病季节性流行的因素。